牙膏中具有防止细菌生长，延长贮存期限是
A. 摩擦剂
B. 防腐剂
C. 润湿剂
D. 胶粘剂
E. 洁净剂

正确答案：B。防腐剂

解析：本题考查牙膏的成分。牙膏中具有防止细菌生长，延长贮存期限是防腐剂（B对）。牙膏中的防腐剂，可防止牙膏的变质等异常，可起到抑菌的作用。牙膏中的摩擦剂（A错），主要是通过摩擦作用，使牙面光洁，利于牙菌斑的清除及减少外源性色素的沉着。牙膏中的湿润剂（C错），即保湿剂，可使牙膏维持一定的湿润度，防止脱水。牙膏中的胶粘剂（D错），可稳定牙膏形态，防止出现水分同固相成分分层。牙膏中的洁净剂（E错），可提高洁净效果，松解牙面的附着物，有助于去除食物残渣，也可起到抑菌作用。